由国务院药品监督管理部门、国务院卫生行政部门共同制定的是
A. 新药临床试验审批办法
B. 药品不良反应报告具体办法
C. 药物临床试验机构资格认定办法
D. 中药品种保护管理办法
E. 药物临床试验质量管理规定

正确答案：C。药物临床试验机构资格认定办法